产生雄性激素的是
A. 精曲小管
B. 精直小管
C. 睾丸网
D. 睾丸间质细胞
E. 无

正确答案：D。睾丸间质细胞

解析：睾丸间质细胞（D对）产生雄性激素。